四环素牙主要受累部位是
A. 牙髓
B. 牙釉质
C. 牙骨质
D. 牙本质
E. 釉牙本质界

正确答案：D。牙本质

解析：四环素色素沉着于牙本质内是沿生长线进行的。牙变色的程度，取决于色素沉着在牙本质内的深度，即与牙本质生长发育时期使用四环素药物的早与迟有着密切的关系。如在牙本质发育的早期服用四环素，色素沉着往往分布于釉牙本质界处，色素就很容易透过釉质而显露出来。此外，服用时间的长短，对牙变色的深浅也有关系，服药时间愈长，则色素沉着带愈宽，色素也就愈深。掌握“四环素牙”知识点。